我国现行饮用水卫生标准规定，管网末梢水中游离氯余量不应低于
A. 0.05mg/L
B. 0.03mg/L
C. 0.01mg/L
D. 0.3mg/L
E. 0.5mg/L

正确答案：A。0.05mg/L

解析：本题考查我国现行饮用水卫生标准规定的管网末梢水中游离氯余量。我国现行饮用水卫生标准规定，用氯气及游离氯制剂消毒时，在接触至少30分钟情况下，出厂水中游离氯不超过4mg/L，游离氯余量
不低于0.3mg/L，管网末梢水中游离氯余量不应低于0.05mg/L（A对BCDE错）。